分子中含有氨基甲酸酯结构，为选择性乙酰胆碱酯酶抑制剂的药物是
A. 吡拉西坦
B. 酒石酸利斯的明
C. 石杉碱甲
D. 回拉西坦
E. 盐酸多奈哌齐

正确答案：B。酒石酸利斯的明

解析：本题考查酒石酸利斯的明的结构。酒石酸利斯的明（B对）分子中含有氨基甲酸酯结构，为选择性乙酰胆碱酯酶抑制剂。